流行性出血热传染源主要是
A. 家畜
B. 患者
C. 蚊虫
D. 毛蚶
E. 鼠类

正确答案：E。鼠类

解析：肾综合征出血热（HFRS），既往称为流行性出血热，是由汉坦病毒引起的以鼠类（E对ABCD错）为主要传染源的自然疫源性急性病毒性传染病。其传染源主要为小型啮齿类动物。我国黑线姬鼠为野鼠型HFRS的主要宿主和传染源，褐家鼠为城市型和家鼠型HFRS的主要传染源，大林姬鼠是林区HFRS的主要传染源。此外，家猫、家兔、狗、猪等家畜可携带汉坦病毒。